心理学的研究对象是人的
A. 心理活动和行为
B. 情绪和行为
C. 心理活动和观念
D. 智力和观念
E. 智力和情绪

正确答案：A。心理活动和行为

解析：心理学研究人的心理现象及其发生发展规律的科学。掌握“医学心理学概述、任务与观点”知识点。